血液进入右心室的口是
A. 右肺静脉口
B. 下腔静脉口
C. 冠状窦口
D. 右房室口
E. 左肺静脉口

正确答案：D。右房室口

解析：右房室口（D对）为血液进入右心室的口，周围有三尖瓣附着于三尖瓣环上。